甲生物制品研发企业基于临床治疗需求，研发上市了一款针对PDL-1靶点用于肿瘤免疫治疗的新药，对多种肿瘤疾病疗效显著。为提升该药品的生产供应能力，甲计划在生产供应不足的情况下，同时委托乙药品生产企业生产，该新药销售由甲承担。作为该药品受托生产企业，乙的《药品生产许可证》分类码应当包括
A. h
B. s
C. d
D. Z

正确答案：B。s

解析：本题考查《药品生产许可证》编号格式。乙的《药品生产许可证》分类码应当包括s（B对）。《药品生产许可证》编号格式为“省份简称+四位年号+四位顺序号”。《药品生产许可证》分类码是对许可证内生产范围进行统计归类的英文字母串。大写字母用于归类药品上市许可持有人和产品类型，包括：A代表自行生产的药品上市许可持有人、B代表委托生产的药品上市许可持有人、C代表接受委托的药品生产企业、D代表原料药生产企业；小写字母用于区分制剂属性，h（A错）代表化学药、z（D错）代表中成药、s代表生物制品、d（C错）代表按药品管理的体外诊断试剂、y代表中药饮片、q代表医用气体、t代表特殊药品、x代表其他。